出现颞叶钩回疝时，有定位意义的瞳孔变化是
A. 患侧瞳孔逐渐扩大
B. 患侧瞳孔逐渐缩小
C. 双侧瞳孔散大
D. 双侧瞳孔缩小
E. 双侧瞳孔大小多变

正确答案：A。患侧瞳孔逐渐扩大

解析：颞叶钩回疝又称小脑幕切迹疝，指颅内压增高使颞叶海马回、钩回通过小脑幕切迹被推移至幕下。由于颞叶钩回、海马回向下移位可牵伸动眼神经，最初可出现一过性的瞳孔缩小，进而患侧动眼神经麻痹，患侧瞳孔逐渐散大，直接和间接对光反射均消失，且有患侧上睑下垂、眼球外斜。因此，出现颞叶钩回疝时，有定位意义的瞳孔变化是患侧瞳孔逐渐散大（A对B错）。双侧瞳孔散大（C错）可见于中脑病变、脑血管病、药物中毒（阿托品等）等，也可见于颞叶钩回疝进行性恶化的病人。双侧瞳孔缩小（D错）可见于药物（吗啡）和有机磷中毒患者。双侧瞳孔大小多变（E错）可见于枕骨大孔疝。